近年来菌痢最常见的菌群是
A. 志贺杆菌
B. 福氏杆菌
C. 宋内杆菌
D. 鲍氏菌
E. 史密菌

正确答案：B。福氏杆菌